与B淋巴细胞瘤发生有关
A. EBV
B. 人乳头瘤病毒
C. 乙型肝炎病毒
D. HIV
E. 人嗜T淋巴细胞病毒-1

正确答案：A。EBV